圈形卡环卡环臂的尖端在上颌磨牙的
A. 颊侧
B. 舌侧
C. 近中面
D. 远中面
E. 邻间隙

正确答案：A。颊侧

解析：圈形卡环：多用于远中孤立的磨牙上，上颌磨牙向近中颊侧倾斜、下颌磨牙向近中舌侧倾斜者。卡环臂的尖端在上颌磨牙的颊侧和下颌磨牙的舌侧。掌握“局部义齿固位体”知识点。